某男。65岁。因肾虚作喘，服用金匮肾气丸后症状稍有缓解，但出现口燥咽干等症状，为进一步改善症状，执业药师建议加服的中成药是
A. 蛇胆川贝液
B. 生脉饮
C. 清气化痰丸
D. 参苏丸
E. 桂龙咳喘宁胶囊

正确答案：B。生脉饮

解析：本题考查的是中成药之间的配伍应用。因肾虚作喘，服用金匮肾气丸后症状稍有缓解，但出现口燥咽干等症状，为进一步改善症状，执业药师建议加服的中成药是生脉散（B对）。用金匮肾气丸治疗肾虚作喘，但若久治不愈，阳损及阴，兼见咽干烦躁者，又当配麦味地黄丸、生脉散或参蛤散同用，以平调阴阳、纳气平喘，且防止金匮肾气丸燥烈伤阴，降低副作用。蛇胆川贝液（A错）含有川贝、半夏，能够止咳化痰，而治疗风寒温痹证的大活络丸、尪痹冲剂、天麻丸、人参再造丸等均含有附子，依据配伍禁忌原则，若将上述两组合用，附子、乌头与川贝、半夏当属相反禁忌同用之列。参苏丸（D错）为气虚感冒的中成药应用。气虚感冒：【中成药应用】常用中成药有参苏丸、败毒散。桂龙咳喘宁胶囊（E错）为喘证风寒闭肺的中成药应用。喘证风寒闭肺证：【中成药应用】常用中成药有小青龙胶囊、风寒咳嗽颗粒、苓桂咳喘宁胶囊、桂龙咳喘宁胶囊。清气化痰丸（C错）的应用，2022年考试指南未明确说明。